脓肿或无效腔的引流物的去除应在
A. 手术后24～48小时
B. 放置24小时后
C. 24小时内去除引流物
D. 一般在24小时内引流量少于20～30ml时去除
E. 渗出液完全消除为止

正确答案：E。渗出液完全消除为止

解析：引流时间：1）感染创口：为防止积血积液而放置的引流物，24～48h后去除；2）脓肿：死腔的引流物应放置至脓液渗液完全消除为止；3）负压引流在24h内引流量少于20～30ml时去除；4）较小创口（下颌下腺、腮腺手术），24h内引流量少于15ml时去除。